牙内陷最轻的一种为
A. 畸形舌侧窝
B. 畸形唇面
C. 畸形根面沟
D. 畸形舌侧尖
E. 牙中牙

正确答案：A。畸形舌侧窝

解析：畸形舌侧窝是牙内陷最轻的一种。由于舌侧窝呈囊状深陷窝，容易滞留食物残渣，利于细菌滋生；再加上囊底存在发育上的缺陷，常引起牙髓的感染、坏死及根尖周病变。掌握“牙内陷”知识点。